除另有规定外，溶散时限为2小时的丸剂为
A. 大蜜丸
B. 小蜜丸
C. 水丸
D. 滴丸
E. 浓缩丸

正确答案：E。浓缩丸

解析：本题考查丸剂的质量要求。除另有规定外，溶散时限为2小时的丸剂为浓缩丸（E对）。丸剂溶散时限：除另有规定外，小蜜丸（B错）、水蜜丸和水丸（C错）应在1小时内全部溶散；浓缩丸和糊丸应在2小时内全部溶散；滴丸（D错）应在30分钟内全部溶散，包衣滴丸应在1小时内全部溶散。蜡丸照崩解时限检查法片剂项下的肠溶衣片检查法检查，在盐酸溶液中（9→1000）检查2小时，不得有裂缝、崩解或软化现象，再在磷酸盐缓冲液（pH6.8）中检查，1小时内应全部崩解。除另有规定外，大蜜丸（A错）及研碎、嚼碎后或用开水、黄酒等分散后服用的丸剂不检查溶散时限。